脊柱
A. 由全部椎骨、骶骨、尾骨及其连结组成
B. 由颈椎、腰椎、骶椎和尾椎构成
C. 其胸段参与构成胸腔和腹腔的骨性后壁
D. 颈曲和骶曲凸向前，胸曲和腰曲凸向后
E. 无

正确答案：A。由全部椎骨、骶骨、尾骨及其连结组成

解析：脊椎由24块椎骨，1块骶骨，1块尾骨（A对B错）组成的。脊柱的颈腰曲凸向前，腰骶凸向后（D错）。